关于舌轴嵴的说法正确的是
A. 舌轴嵴只存在于上颌尖牙
B. 上颌切牙也有舌轴嵴
C. 上颌尖牙有一条舌轴嵴
D. 上颌尖牙的近中舌窝较远中舌窝大
E. 下颌切牙舌窝被舌轴嵴分为两个舌窝

正确答案：C。上颌尖牙有一条舌轴嵴

解析：上颌尖牙的舌侧由牙尖伸向舌隆突有一纵嵴称为舌轴嵴，舌窝被舌轴嵴分成较小的近中舌窝和较大的远中舌窝。掌握“上下颌前牙的外形及临床应用解剖”知识点。